下列各项，属于脑膜刺激征的是
A. 布鲁津斯基征
B. 查多克征
C. 巴宾斯基征
D. 戈登征
E. 拉塞格征

正确答案：A。布鲁津斯基征

解析：脑膜受激惹的体征，是脑膜病变时脊髓膜受到刺激并影响到脊神经根，当牵拉刺激时引起相应肌群反射性痉挛的一种病理反射，包括颈强直、Kernig征、Brudzinski征（A对）（布鲁津斯基征是指病人仰卧，双下肢自然伸直，检查者前屈其颈部时发生双侧膝关节和髋关节一过性屈曲，压迫其双侧颊部引起双臂外展和肘部屈曲，叩击其耻骨联合时出现双下肢屈曲）。查多克征（B错）属于病理反射，阳性表现为拇趾背屈，其余四趾呈扇形散开，阳性是锥体束损害时最重要的体征。巴宾斯基征（C错）属于病理反射，患者仰卧，髋、膝关节伸直，检查者左手握踝上部固定小腿，右手持钝尖的金属棒自足底外侧从后向前快速轻划至小指根部，再转向拇趾侧。正常出现足趾向跖面屈曲，称巴彬斯基征阴性。如出现拇趾背屈，其余四趾成扇形分开，称巴彬斯基征阳性。戈登征（D错）属于病理反射，阳性表现为拇趾背屈，其余四趾呈扇形散开。拉塞格征（E错）拉塞格征又称直腿抬高加强试验，为神经根受刺激的表现。